下列哪项不是稽留性流产严重出血的原因
A. 妊娠子宫血运丰富特易出血
B. 胎盘机化，粘连宫壁，易致残留
C. 稽留日久，易发生凝血功能障碍
D. 雌激素不足，子宫对催产素不敏感，易宫缩不良
E. 胚胎组织粘连宫壁，刮宫易致子宫穿孔

正确答案：A。妊娠子宫血运丰富特易出血

解析：妊娠子宫血运丰富特易出血。是妊娠期的子宫，不是稽留流产特易性特点。掌握“自然流产”知识点。